需要治疗的无症状性菌尿见于
A. 老年女性
B. 长期留置导尿
C. 糖尿病
D. 绝经期前非妊娠妇女
E. 妊娠妇女

正确答案：E。妊娠妇女

解析：无症状性菌尿是指患者有真性细菌尿，而无尿路感染的症状，可由症状性尿感演变而来或无急性尿路感染病史（P493）。无症状性菌尿是否治疗目前有争议，一般认为有下述情况者应予治疗：①妊娠期无症状细菌尿（E对）；②学龄前儿童；③曾出现有症状感染者；④肾移植、尿路梗阻、其他尿路复杂情况者。老年女性（A错）、绝经期前非妊娠妇女（D错）的无症状性菌尿均无需治疗。长期留置导尿（B错）、糖尿病（C错）不是目前无症状学菌尿应予以治疗的适应症。